能化瘀止血的药有
A. 三七
B. 蒲黄
C. 茜草
D. 藕节
E. 炮姜

正确答案：A、B、C。三七；蒲黄；茜草

解析：本题考查的是化瘀止血药的功效。能化瘀止血的药有三七（A对）、蒲黄（B对）与茜草（C对）。三七：【功效】化瘀止血，活血定痛。蒲黄：【功效】活血祛瘀，收敛止血，利尿通淋。茜草：【功效】凉血，祛瘀，止血，通经。藕节（D错）：【功效】收敛止血。炮姜（E错）：【功效】温经止血，温中止痛。